双盲法的具体内容是
A. 试验组和对照组均了解自己所属组别
B. 试验组和对照组均不了解自己所属组别
C. 研究对象不了解自己所属组别，观察者也不知道研究对象所属组别
D. 研究对象及观察者均了解研究对象所属组别
E. 以上均不是

正确答案：C。研究对象不了解自己所属组别，观察者也不知道研究对象所属组别